阴痒肝经湿热型治疗首选
A. 萆薢渗湿汤
B. 五淋散
C. 知柏地黄丸
D. 清肝止淋汤
E. 龙胆泻肝汤

正确答案：E。龙胆泻肝汤

解析：阴痒症状可以出现在阴道炎症，故可判断为阴道炎症的肝经湿热型治疗宜首选龙胆泻肝汤（E对）。阴道炎症 湿虫滋生证 证候∶阴部瘙痒，如虫行状，甚则奇痒难忍，灼热疼痛，带下量多，色黄呈泡沫状，或色白如豆渣状，臭秽，心烦少寐，胸闷呃逆，口苦咽干，小便黄赤。舌红苔黄腻，脉滑数。治法∶清热利湿，解毒杀虫。方药∶萆薢渗湿汤（A错）。五淋散主要用于膀胱有热，水道不通，尿少次频，脐腹急痛等病症（B错）。知柏地黄丸用于阴虚火旺，潮热盗汗，口干咽痛，耳鸣遗精，小便短赤（C错）。清肝止淋汤主治赤带，带下色红，似血非血，淋沥不断（D错）。